莱菔子不具有的药理作用是
A. 助消化
B. 缓解心绞痛
C. 镇咳
D. 祛痰
E. 抗菌

正确答案：B。缓解心绞痛